检查青霉素钠中青霉素聚合物的方法是
A. 焰色反应法
B. 干燥失重测定法
C. 分子排阻色谱法
D. 红外分光光度法
E. 反相高效液相色谱法

正确答案：C。分子排阻色谱法

解析：本题考查青霉素聚合物的检查。青霉素聚合物为高分子杂质，《中国药典》采用分子排阻色谱法（C对）检查聚合物类杂质。